患者因饮食不洁，突发频繁呕吐，腹痛，腹泻，呈水样便，无粘液及脓血，亦无里急后重，体温升高。应首先考虑的是
A. 霍乱
B. 血吸虫病
C. 急性胃肠炎
D. 阿米巴痢疾
E. 轻型细菌性痢疾

正确答案：E。轻型细菌性痢疾

解析：轻型细菌性痢疾（E对），全身毒血症状和肠道症状均较轻，可无发热或仅低热，腹痛轻微，里急后重感不明显，大便每日少于10次，为稀便或稀水便，有黏液但无脓血；霍乱（A错）一般无发热，为先泻后吐，大便为黄色水样或或洗肉水样，呕吐次数不多；血吸虫病（B错）大便带血和黏液，不是水样便；急性胃肠炎（C错）腹部症状明显，先有腹部不适，继而腹痛，多伴恶心呕吐，常先吐后泻，大便有稀便、水样便或黏液便；阿米巴痢疾（D错）大便呈暗红色果酱样，多不发热。